某健康小孩，身高110cm，其年龄大约应为几岁
A. 3岁
B. 4岁
C. 5岁
D. 6岁
E. 7岁

正确答案：C。5岁

解析：本题考查正常儿童身高估计公式。某健康小孩，身高110cm，根据身高估计公式：身高（㎝）=年龄（岁）×7+75，年龄（岁）=（身高（㎝）-75）÷ 7，可得知其年龄大约应5岁（C对）。